毒性是指一种物质对机体造成损伤的
A. 能力
B. 特性
C. 可能性
D. 危险性
E. 危害性

正确答案：A。能力